属于盆腔炎性疾病诊断特异性标准（2010年美国CDC诊断标准）是
A. 宫颈举痛或子宫压痛或附件区压痛
B. 实验室证实宫颈淋病奈瑟菌或衣原体阳性
C. 宫颈或阴道异常粘液脓性分泌物
D. 阴道分泌物生理盐水涂片见大量白细胞
E. 经阴道超声或磁共振检查显示输卵管增粗，输卵管积液

正确答案：E。经阴道超声或磁共振检查显示输卵管增粗，输卵管积液

解析：盆腔炎性疾病诊断特异性标准（2010年美国CDC诊断标准）包括：子宫内膜活检组织学证实子宫内膜炎；阴道超声或磁共振检查显示输卵管增粗，输卵管积液（E对），伴或不伴有盆腔积液、输卵管卵巢肿块，或腹腔镜检查发现盆腔炎性疾病征象。最低标准是宫颈举痛或子宫压痛或附件区压痛（A错）。附加标准包括：体温超过38.3℃（口表）；宫颈或阴道异常粘液脓性分泌物（C错）；阴道分泌物生理盐水涂片见大量白细胞（D错）；红细胞沉降率升高；血C-反应蛋白升高；实验室证实宫颈淋病奈瑟菌或衣原体阳性（B错）。